患者心悸，心烦不寐，两颧发红，盗汗，舌红少苔，脉细数。其治法是
A. 益气活血
B. 温补心阳
C. 滋阴安神
D. 温阳利水
E. 泻肺利水

正确答案：C。滋阴安神

解析：心悸患者，心烦不寐，为阴虚火旺，上扰心神所致；两颧发红，盗汗，舌红少苔，脉细数，均为阴虚之征；辩证为心悸阴虚火旺证，治宜滋阴清火，养心安神（C对）。益气活血适用于心悸气虚血瘀证（A错）。温补心阳，安神定悸适用于心悸心阳不振证（B错）。温阳利水适用于心悸水饮凌心证（D错）。泻肺利水适用于悬饮饮停胸胁证（E错）。